女性，54岁，诊断为急性坏疽性阑尾炎伴弥漫性腹膜炎入院，行阑尾切除术。术后第5天腹胀、腹痛、发热，体温39℃，大便4～6次/日，呈水样。肛门有下坠感，腹部有轻压痛，未触及肿块。首先应考虑的并发症是
A. 急性肠炎
B. 阑尾残株炎
C. 门静脉炎
D. 肠间隙脓肿
E. 盆腔脓肿

正确答案：E。盆腔脓肿

解析：中年女性患者，主因急性坏疽性阑尾炎伴弥漫性腹膜炎（腹腔脓肿的常见原因）入院，阑尾切除术后第5天出现腹胀、腹痛，发热（提示感染），大便频、呈水样，肛门有下坠感（直肠刺激症状），结合患者病史和体查，应考虑为阑尾切除术后并发盆腔脓肿（E对）。急性肠炎（A错）主要表现为恶心、呕吐、腹痛、腹泻、稀水便或黏液血便，少见发热和里急后重等直肠刺激症状；阑尾残株炎（B错）指阑尾切除术后阑尾残端保留超过1cm，或者肠石残留，残株复发炎症，仍表现为阑尾炎的症状。门静脉炎（C错）主要表现为寒战、高热、肝大、剑突下压痛，无直肠刺激症状。肠间隙脓肿（D错）指脓液被包围在肠管、肠系膜与网膜之间的脓肿，临床上可出现化脓性感染症状，伴腹痛、腹胀，查体可扪及腹部包块。